处方的有效期限一般为
A. 当日
B. 三日
C. 五日
D. 七日
E. 十四日

正确答案：A。当日

解析：本题考查处方限量。处方开具当日（A对）有效。特殊情况下需延长有效期的，由开具处方的医师注明有效期限，最长不得超过3天。